少阴经头痛的特征是
A. 前额连眉棱骨痛
B. 两侧太阳穴处痛
C. 后头部连项痛
D. 头痛连齿
E. 头痛晕沉

正确答案：D。头痛连齿

解析：头痛连齿者，属少阴经头痛，因少阴肾脉主骨生髓充于脑，脑为髓海（D对）。阳明经与任脉行于头前，故前额连眉棱骨痛，病在阳明经（A错）。少阳经行于头两侧，故头两侧太阳穴处痛，病在少阳经（B错）。太阳经与督脉行于头后，故后头部连项痛，病在太阳经（C错）。头痛晕沉，腹泻自汗者，属太阴脾经。因脾属中州而主升，脾虚则清阳不升（E错）。